进口比利时生产的降压药应取得
A. 《进口准许证》
B. 《卫生许可证》
C. 《医药产品注册证》
D. 《进口药品注册证》
E. 《药品生产许可证》

正确答案：D。《进口药品注册证》

解析：本题考查的是进口药品注册管理。进口比利时生产的降压药应取得《进口药品注册证》（D对）。进口药品注册管理：在新修订《药品管理法》和《药品注册管理办法》实施之前，我国对申请进口的药品实施与国产药品有所区别的注册管理模式。一是，原则上要求申请进口的药品，应当获得境外制药厂商所在生产国家或者地区的上市许可，未在生产国家或者地区获得上市许可，但经国家药品监督管理部门确认该药品安全、有效而且临床需要的，可以批准进口。二是对于批准进口我国的药品发给《进口药品注册证》，对于中国香港、澳门和台湾地区企业生产的药品参照进口药品注册申请的程序办理，并发给《医药产品注册证》（C错），而均不核发药品批准文号，《进口药品注册证》《医药产品注册证》在补充申请、再注册等方面的具体管理方式也有别于药品批准文号。三是对于进口药品的进口备案、报关、口岸检验以及进口通关等，国务院药品监督管理部门和海关总署联合制定了《药品进口管理办法》，以规范相关工作的开展。除2007年修订的《药品注册管理办法》外，原国家食品药品监督管理局发布的《关于进口药品再注册有关事项的公告》（国食药监注〔2009〕18号，以下简称18号公告）对进口药品再注册和分包装申报、受理、审批，再注册核档程序、再注册期间临时进口和分包装、再注册涉及的补充申请，再注册和补充申请注册证编发等有关事项，进一步作了规范。18号公告与《药品注册管理办法》《药品进口管理办法》一并构成了我国进口药品注册管理的基本制度体系。进口麻醉药品、精神药品以及蛋白同化制剂、肽类激素需有《进口准许证》（A错）。从事药品生产活动，应当经所在地省、自治区、直辖市药品监督管理部门批准，依照规定取得《药品生产许可证》（E错）。无药品生产许可证的，不得生产药品。